长期饥饿状态下，在血浆中含量明显减少的蛋白是
A. α₁-球蛋白
B. α₂-球蛋白
C. β-球蛋白
D. γ-球蛋白
E. 清蛋白

正确答案：E。清蛋白